用左旋多巴或M受体阻断剂治疗震颤性麻痹，不能缓解的症状是
A. 肌肉强直
B. 随意运动减少
C. 动作缓慢
D. 面部表情呆板
E. 静止性震颤

正确答案：E。静止性震颤

解析：震颤麻痹又称帕金森病，病因是双侧黑质病变，多巴胶能神经元变性受损，其主要症状是全身肌紧张增高，肌肉强直，随意运动减少，动作缓慢，面部表情呆板，常伴有静止性震颤。 临床上给予多巴胺的前体左旋多巴和M受体拮抗剂能治疗此病。故左旋多巴或M受体阻断剂可以缓解肌肉强直（A错）、随意运动减少（B错）、动作缓慢（C错）和面部表情呆板（D错），但对静止性震颤均无明显疗效（E对）。但当破坏丘脑外侧腹核时静止性震颤消失，因而静止性震颤可能与丘脑外侧腹核等结构的功能异常有关。